适度的应激对于大多数人来说可以
A. 导致疾病
B. 加重疾病
C. 引起生理障碍
D. 引起心理障碍
E. 促进人体适应

正确答案：E。促进人体适应

解析：应激是指个体对某种意外的环境刺激所做出的适应性反应，是个体觉察到环境的威胁或挑战而产生的适应或应对反应。根据应激的定义，适度的应激可以促进人体适应（E对）。应激既有积极作用，也有消极作用。一般应激状态使机体具有特殊的防御或排险功能，使人精力旺盛，活动量增大，思维特别清晰，动作机敏，帮助人化险为夷，及时摆脱困境。但应激也会使人产生全身兴奋，注意和知觉的范围缩小、言语不规则、不连贯，行为动作紊乱等表现。紧张而又长期的应激甚至会导致休克和死亡。